水体的污染源主要有
A. 工业废水、生活污水、农业污水
B. 冷却水、洗涤污水、化工污水
C. 有机污水、无机污水、混合性污水
D. 物理性污水、化学性污水、生物性污水
E. 有机污水、无机污水、物理性污水、化学性污水

正确答案：A。工业废水、生活污水、农业污水

解析：本题考查水体的污染源。水体污染源通常指向水体排放污染物的场所、设备和装置等，也包括污染物进入水体的途径。造成水体污染的原因是多方面的，其主要来源有以下几方面：①工业废水：它是世界范围内水污染的主要原因。指工业生产过程的各个环节产生的废水，如冷却水，洗涤废水，水力选矿废水，水力除渣废水，生产浸出液等；②生活污水：指人们日常生活的洗涤废水和粪尿污水等；③农业污水（A对BCDE错）：指农牧业生产排出的污水及降水或灌溉水流过农田或经农田渗漏排出的水。